麻黄除发汗解表外，又能
A. 宣肺平喘
B. 透疹止痒
C. 化湿和中
D. 燥湿止带
E. 通窍止痛

正确答案：A。宣肺平喘

解析：本题考查的是麻黄的功效。麻黄除发汗解表外，又能宣肺平喘（A对）。麻黄：【功效】发汗解表，宣肺平喘，利水消肿。荆芥：【功效】散风解表，透疹止痒（B错），止血。香薷：【功效】发汗解表，和中化湿（C错），利水消肿。白芷：【功效】发散风寒，通窍止痛（E错），燥湿止带（D错），消肿排脓。